小学3-4年级学生每天学习总时数不应超过
A. 4小时
B. 5小时
C. 6小时
D. 7小时
E. 8小时

正确答案：B。5小时